袢利尿剂中，耳毒性大，临床使用受到限制的药物是
A. 呋塞米
B. 阿米洛利
C. 依他尼酸
D. 布美他尼
E. 氢氯噻嗪

正确答案：C。依他尼酸

解析：本题考查依他尼酸的临床应用。依他尼酸（C对）是一个非磺酰胺衍生物的袢利尿剂，与其他袢利尿剂比较耳毒性更大，因此临床使用受到限制。